药品说明书中提及“两种药物在吸收过程中，会发生相互影响，不能同时服药”，但没有明示服药间隔时间，通常建议的间隔时间是
A. 0.5小时
B. 1小时
C. 2小时
D. 3小时
E. 4小时

正确答案：C。2小时

解析：本题考查多药合用时服药间隔时间。多药合用，需交代服药间隔时间。若药品说明书中没有明示间隔时间，则一般间隔为2小时（C对）。若药品说明书中没有明示间隔时间，则一般间隔为2小时。